下列中毒性细菌性痢疾的治疗措施，错误的是
A. 抗菌治疗
B. 扩充血容量
C. 纠正代谢性酸中毒
D. 应用血管活性药物
E. 纠正代谢性碱中毒

正确答案：E。纠正代谢性碱中毒

解析：中毒性菌痢应采取综合急救措施，力争早期治疗。1.对症治疗（1）降温止惊 高热应给予物理降温，必要时给予退热药；高热伴烦躁、惊厥者，可采用亚冬眠疗法。（2）休克型 主要措施；①迅速扩充血容量纠正酸中毒（BC对）；快速给予葡萄糖盐水、5%酸氢钠及低分子右旋糖酐等溶液，补液量及成分视脱水情况而定，休克好转后则继续静脉输液维持。②改善微循环障碍：此型主要为高阻低排性休克，可给予山莨菪碱、酚妥拉明、阿托品等药物，以改善重要脏器血流灌注。如血压仍不回升，可给予多巴胺、间羟胺等药物。③保护重要脏器功能：主要保护心、脑、肾等重要脏器的功能。④其他：可使用糖皮质激素，有早期DIC表现者可给予肝素抗凝等治疗。（3）脑型 可给予20%露醇每次1～2g/kg快速静脉滴注，每4～6小时注射一次，以减轻脑水肿。应用血管活性药物以改善脑部微循环（D对）、同时给予糖皮质激素有助于改善病情。防治呼吸衰竭需要保持呼吸道通畅、吸氧，如出现呼吸衰竭可使用洛贝林、尼可刹米等药物，必要时可应用呼吸机。2.抗菌治疗（A对） 药物选择基本与急性菌痢相同，应先采用静脉给药，可选用环丙沙星、左旋氧氟沙星等喹诺酮类或三代头孢菌素类抗菌药物。病情好转后改为口服，剂量和疗程同急性菌痢（E错，为本题正确答案）。